感染病原体后，仅引起机体发生特异性免疫应答，而临床上不出现特异性的症状和体征，称为
A. 显性感染
B. 潜伏性感染
C. 隐性感染
D. 病原携带状态
E. 病原体被清除

正确答案：C。隐性感染

解析：隐性感染（C对）是病原侵入人体后，临床上不显示出任何症状、体征，但可产生特异性免疫。显性感染（A错）不但引起机体发生免疫应答，而且导致组织损伤，引起病理改变和临床表现。潜伏性感染（B错）病原体寄生在机体中某些部位，由于机体免疫功能足以将病原体局限化而不引起显性感染，但又不足以将病原体清除，病原体便可长期潜伏下来。病原携带状态（D错），病原体在人体内停留于入侵部位或在离入侵处较远脏器继续生长繁殖，而人体不出现疾病的临床表现。病原体被清除（E错）是病原体进入人体后，首先可被机体非特异性防御能力所清除。